古代载药最多的本草著作是
A. 《证类本草》
B. 《新修本草》
C. 《神农本草经》
D. 《本草纲目》
E. 《本草纲目拾遗》

正确答案：D。《本草纲目》

解析：本题考查的是《本草纲目》。古代载药最多的本草著作是《本草纲目》（D对）。《本草纲目》：简称《纲目》，为明代本草代表作。作者李时珍，在公元1578年（明万历六年）完成这一巨著。全书共52卷，约200万字，载药1892种，绘药图1100余幅，附方11000余首。《证类本草》（A错）：即《经史证类备急本草》，为宋金元时期宋代的本草代表作。作者唐慎微。书稿定稿于1108年（宋大观二年）以前。全书共30卷，载药1746种，附方3000余首。《新修本草》（B错）：又称《唐本草》，为隋唐时期唐代的本草代表作。书成于公元659年（唐显庆四年），共54卷，载药850种。《神农本草经》（C错）：简称《本经》，为汉代本草代表作。各论载药365种，以上、中、下三品分类，所记功用大多朴实有验。《本草纲目拾遗》（E错）：简称《纲目拾遗》，为清代本草代表作。作者赵学敏，定稿于1803年（清嘉庆八年）。全书共10卷，载药921种，其中新增716种，创古本草增收新药之冠，极大地丰富了本草学。